维生素B₁的生理功能主要为
A. 作为转酮醇酶的辅酶参与转酮醇作用
B. 以NAD和NADP的形式参与呼吸链
C. 作为一碳单位的运载体
D. 与核酸的合成相关
E. 作为羟化过程底物和酶的辅因子

正确答案：A。作为转酮醇酶的辅酶参与转酮醇作用